不易发生“双硫仑样”反应的药物是
A. 头孢曲松
B. 头孢哌酮
C. 头孢他啶
D. 头孢替安
E. 头孢匹胺

正确答案：C。头孢他啶

解析：本题考查双硫仑样反应。头孢他啶（C错，为本题正确答案）不含甲硫四氮唑侧链和甲硫三嗪侧链，不易发生双硫仑样反应。头孢曲松（A对）含甲硫三嗪侧链，头孢哌酮（B对）、头孢替安（D对）、头孢匹胺（E对）含甲硫四氮唑，均可引起此类反应。